患者气短。查体：气管向左偏移，右侧胸廓饱满，叩诊出现实音。应首先考虑的是
A. 右侧胸腔积液
B. 右侧气胸
C. 肺气肿
D. 右侧胸膜增厚
E. 右侧肺不张

正确答案：A。右侧胸腔积液

解析：患者气短。查体：气管向左偏移，右侧胸廓饱满（右侧胸腔积液典型体征），叩诊出现实音。应首先考虑的是右侧胸腔积液（A对）。右侧气胸（P123）（B错）可见右侧胸部隆起，呼吸运动与触觉语颤减弱，叩诊过清音或鼓音。肺气肿（C错）可见胸廓呈桶状，叩诊过清音。右侧胸膜增厚（D错）可见气管向右偏移，右侧胸廓缩小，叩诊呈实音。右侧肺不张（E错）常见气管向右侧偏移，右侧胸廓平坦，叩诊浊音。